关于钠-葡萄糖协同转运蛋白-2（SLGT-2）抑制剂达格列净作用特点和不良反应的说法，错误的是
A. 降糖效果受肾小球滤过的葡萄糖负荷的影响
B. 降糖作用不依赖于胰岛B细胞的功能及机体对胰岛素的敏感性
C. 适用于1型糖尿病或糖尿病酮症酸中毒
D. 重度肾功能不全患者禁用
E. 可降低血压，减轻体重

正确答案：C。适用于1型糖尿病或糖尿病酮症酸中毒

解析：本题考查达格列净的不良反应。达格列净禁用于1型糖尿病、有糖尿病酮症酸中毒（C错，为本题正确答案）倾向的2型糖尿病患者。目前在我国被批准临床使用的SGLT-2抑制剂为达格列净、恩格列净和卡格列净。SGLT-2抑制剂的常见不良反应为生殖泌尿道感染。罕见的不良反应包括酮症酸中毒，主要发生在1型糖尿病患者；以及急性肾损伤、骨折风险和足趾截肢。SGLT-2抑制剂单独使用时不增加低血糖发生的风险，SGLT-2抑制剂可降低血压，减轻体重（E对）。重度肾功能不全患者禁用（D对）。达格列净降糖效果受肾小球滤过的葡萄糖负荷的影响（A对），降糖作用不依赖于胰岛B细胞的功能及机体对胰岛素的敏感性（B对）。